郁金不具有的功能是
A. 活血止痛
B. 行气解郁
C. 凉血清心
D. 利胆退黄
E. 泻火解毒

正确答案：E。泻火解毒

解析：本题考查郁金的功效。郁金不具有的功能是泻火解毒（E错，为本题正确答案）。郁金【功效】活血止痛（A对），行气解郁（B对），凉血清心（C对），利胆退黄（D对）。黄连【功效】清热燥湿，泻火解毒。